结脉与促脉的主要不同点，在于
A. 脉位的浮沉
B. 脉力的大小
C. 脉形的长短
D. 脉率的快慢
E. 脉律的齐否

正确答案：D。脉率的快慢

解析：结脉与促脉均有歇止的脉象。但促脉为脉数而中止，结脉为脉缓而中止，二者歇止均不规则（D对）。结脉与促脉的脉位正常，非浮非沉（A错）。结脉与促脉的脉力大小多与病因相关，如结脉因寒痰血瘀而失于宣畅则脉力大，而久病气血衰，则脉力小（B错）。结脉与促脉脉形正常，非长非短（C错）。结脉与促脉脉律都是时有一止，止无定数（E错）。